鱼精蛋白可用于救治
A. 肝素过量导致的出血
B. 吗啡过量导致的呼吸抑制
C. 华法林过量导致的出血
D. 异烟肼中毒导致的神经毒性
E. 对乙酰氨基酚中毒导致的肝损伤

正确答案：A。肝素过量导致的出血

解析：本题考查鱼精蛋白的作用。鱼精蛋白带有正电荷，可与肝素结合形成稳定的复合物，使肝素失去抗凝血作用，用于救治肝素过量导致的出血（A对）。